发生液性病变时可穿刺出不凝固血性液体的肿瘤是
A. 神经纤维瘤
B. 神经鞘瘤
C. 骨肉瘤
D. 造釉细胞瘤
E. 血管内皮瘤

正确答案：B。神经鞘瘤

解析：本题考查发生液性病变时可穿刺出不凝固血性液体的肿瘤。神经鞘瘤发生液性病变时可穿刺出不凝固血性液体（B对），是由于肿瘤发生黏液性变而形成的。神经纤维瘤（A错）质地柔软，瘤内血运丰富，故穿刺时抽出正常血液可以凝固。骨肉瘤（C错）的主要组织成分为肿瘤性成骨细胞、肿瘤性骨样组织和肿瘤骨。有的瘤体生长迅速而血运不足，以致部分肿瘤坏死形成含棕色或血性液体的囊肿，有的瘤体生长迅速而血运丰富，肿瘤组织含有极多的扩张血管，以致肿瘤产生搏动和杂音，形成假性动脉瘤，穿刺抽出液体都可以凝固。造釉细胞瘤（D错）大多为实质性，如囊性成分较多时，穿刺检查可抽出褐色液体，可以凝固。血管内皮瘤（E错）呈暗红色，无明显包膜，质地韧，血管丰富，穿刺可抽出凝固的血液。